男，68岁，慢性阻塞性肺疾病（COPD）病史12年，动脉血气分析pH为7.36，PaO₂43mmHg，PaCO₂52mmHg。对该患者可以改善预后的措施是
A. 预防性使用抗生素
B. 吸入糖皮质激素
C. 使用支气管舒张剂
D. 肺康复锻炼
E. 长期家庭氧疗

正确答案：E。长期家庭氧疗

解析：中老年男性，慢性阻塞性肺疾病病史，PaO₂43mmHg，PaCO₂52mmHg（PaO₂＜60mmHg，PaCO₂＞50mmHg，可诊断该患者为Ⅱ型呼吸衰竭）。此患者慢阻肺并发Ⅱ型呼吸衰竭，PaO₂≤55mmHg，使用长期家庭氧疗（LTOT）（E对）可提高生活质量和生存率，对血流动力学、运动能力和精神状态均会产生有益的影响。慢阻肺急性加重期患者可根据患者所在地常见病原菌及其药物敏感情况积极选用抗生素治疗，而稳定期慢阻肺患者不主张预防性使用抗生素（A错）。吸入糖皮质激素（B错）可增加运动耐量、减少急性发作频率、提高生活质量，但不能改善预后。使用支气管舒张剂（C错）主要用于严重喘息症状，而并不能改善慢阻肺预后。肺康复锻炼（D错）包括健康教育、运动锻炼、物理治疗等，为一般性治疗措施，并非慢阻肺患者可以改善预后的措施。